选择性钙离子通道阻滞药是
A. 氟桂嗪
B. 普尼拉明
C. 哌克昔林
D. 硝苯地平
E. 桂利嗪

正确答案：D。硝苯地平